催化转录合成RNA的酶是
A. 反转录酶
B. 引物酶
C. DNA指导的RNA聚合酶
D. 转移酶
E. 拓扑异构酶

正确答案：C。DNA指导的RNA聚合酶

解析：催化转录合成RNA的酶是DNA指导的RNA聚合酶（C对），催化以DNA为模板合成RNA的过程。反转录酶即逆转录酶（A错）催化的是以RNA为模板合成DNA的过程，引物酶（B错）催化引物RNA的合成。肽基转移酶（D错）催化两个氨基酸间肽键形成的反应。拓朴异构酶（E错）用于松解超螺旋结构。